以下胃肠道病毒及其所致人类疾病对应关系错误的是
A. 埃可病毒——神经、呼吸消化道感染
B. 脊髓灰质炎病毒——脊髓灰质炎
C. 柯萨奇病毒——神经、呼吸消化道、心脏感染
D. 肠道病毒70型——神经系统感染，手足口病
E. 轮状病毒——婴幼儿腹泻、成人腹泻

正确答案：D。肠道病毒70型——神经系统感染，手足口病